属于器官特异性自身免疫病的是
A. SLE
B. 全身性硬皮病
C. 多发性肌炎
D. 干燥综合征（Sjogren syndrom）
E. 甲状腺功能亢进症（Graves病）

正确答案：E。甲状腺功能亢进症（Graves病）